呼吸有烂苹果味最常见于
A. 糖尿病酮症酸中毒
B. 肝性脑病
C. 尿毒症
D. 酒精中毒
E. 有机磷农药中毒

正确答案：A。糖尿病酮症酸中毒

解析：呼吸呈刺激性蒜味见于有机磷杀虫药中毒者（E错）；烂苹果味见于糖尿病酮症酸中毒者（A对）；氨味见于尿毒症者（C错）；肝腥味见于肝性脑病者（B错）。酒精中毒常表现为行为和意识的异常（D错）。